以生乳和（或）乳制品为原料，经加工制成的黏稠状产品是
A. 超高温灭菌乳
B. 奶油
C. 奶酪
D. 调制乳
E. 淡炼乳

正确答案：E。淡炼乳

解析：本题考查淡炼乳。淡炼乳（E对ABCD错）是以生乳和（或）乳制品为原料，添加或不添加食品添加剂和营养强化剂，经加工制成的黏稠状产品。